以软骨变性破坏为主要病理改变的风湿病是
A. 类风湿关节炎
B. 强直性脊柱炎
C. 风湿热关节受累
D. 骨性关节炎
E. 痛风性关节炎

正确答案：D。骨性关节炎

解析：软骨变性破坏是骨关节炎（D对）最基本的病理改变。类风湿关节炎（A错）的基本病理改变是滑膜炎和血管炎（P807）。强直性脊柱炎（B错）的基本病变为肌腱、韧带和关节囊等附着于骨关节部位的非特异性炎症、纤维化以至骨化（P825）。风湿热关节受累（C错）病理基础有滑膜及周围组织水肿，滑膜下结缔组织中有粘液性变，纤维素样变及炎症细胞浸润，有时有不典型的风湿小体。痛风性关节炎（E错）是由尿酸盐结晶沉积引起的关节炎症反应（P861）。